女性，54岁。绝经5年，近2个月阴道流水样白带，近2周出现阴道间断少量血性排液。妇科检查宫颈光滑，宫体稍大且软，双侧附件未扪及异常。最有确诊价值的方法是
A. B超检查
B. 阴道镜检查
C. 分段诊断刮宫病理检查
D. 进行碘试验和阴道镜检查
E. 阴道后穹隆分泌物涂片检查

正确答案：C。分段诊断刮宫病理检查

解析：女性患者，54岁，绝经5年，近2个月阴道流水样白带，近2周阴道间断少量血性排液，绝经后妇女若出现不规则阴道流血及血性阴道排液，首先考虑子宫内膜癌，最有价值的方法是分段诊断刮宫病理检查（C对），组织学检查是子宫内膜癌的确诊依据。B超检查（A错）可对异常阴道流血的原因做出初步诊断并作为进一步检查的选择提供参考，可用于筛查。阴道镜检查（B错）可以发现宫颈与癌变有关的异型性上皮、异型血管，再对可疑部位进行定位活检，有助于提高确诊率，但不是确诊的检查手段（P443～P444），对子宫内膜癌诊断价值不大。碘试验（D错）是用于阴道镜检查的一种试验方法，利用复方碘溶液对宫颈细胞进行染色，染色后观察不着色区域的分布，对可疑部位取多点活检送病理检查，有助于提高确诊率，但通过单纯观察不能确诊。阴道后穹隆分泌物涂片检查（E错）对子宫内膜癌的诊断意义不大。